缩写IR是指
A. 气相色谱法
B. 高效液相色谱法
C. 十八烷基硅烷键合硅胶
D. 红外分光光度法
E. 差示扫描量热法

正确答案：D。红外分光光度法

解析：本题考查常用的药品鉴别方法。缩写IR是指红外分光光度法（D对）。红外分光光度法（IR）是通过测定被测物质在特定波长处或一定波长范围内（红外光区）光的吸收度，对该物质进行定性和定量分析的方法。气相色谱法（A错）缩写为GC；高效液相色谱法（B错）缩写为HPLC；十八烷基硅烷键合硅胶（C错）缩写为ODS；差示扫描量热法（E错）缩写为DSC。